一个测验工具中对于对象可以测量到的程度，是指该工具的
A. 常模
B. 信度
C. 效度
D. 样本
E. 标准

正确答案：C。效度